医师胡某与一药厂达成协议后，在处方时使用了该药厂生产的药品，并收受了该厂给予的提成。对于胡某的违法行为，有权决定给予行政处分并没收其违法所得的部门是
A. 药品监督管理部门
B. 工商行政管理部门
C. 监察部门
D. 消费者权益保护协会
E. 卫生行政部门

正确答案：E。卫生行政部门

解析：医师胡某与一药厂达成协议后，在处方时使用了该药厂生产的药品，并收受了该厂给予的提成。根据相关规定，医师胡某应由卫生行政部门（E对）或者本单位给予处分，没收违法所得；该药厂应由工商行政管理部门（B错）处1万元以上20万元以下的罚款，有违法所得的，予以没收。